下列关于多形性腺瘤特点的描述正确的一项是
A. 光镜下表现为细胞多形性而不是结构多形性
B. 是最常见的唾液腺恶性肿瘤
C. 大唾液腺以下颌下腺为主，小唾液腺以腭腺多见
D. 临床上生长迅速，肿瘤不规则
E. 表面有结节，触之软硬不一，可活动

正确答案：E。表面有结节，触之软硬不一，可活动

解析：本题考查多形性腺瘤。下列关于多形性腺瘤特点的描述正确的一项是表面有结节，触之软硬不一，可活动（E对）。多形性腺瘤是一种包膜情况不一，光镜下以结构多形性而不是细胞多形性为特征的肿瘤（A错）。在唾液腺良性肿瘤中最常见（B错），大唾液腺主要发病于腮腺（C错），小唾液腺以腭部多见。临床上通常生长缓慢，形状不规则（D错），表面有结节，触之软硬不一，可活动（E对）。